右房室口周缘附着有
A. 二尖瓣
B. 三尖瓣
C. 肺动脉瓣
D. 主动脉瓣
E. 半月瓣

正确答案：B。三尖瓣

解析：三尖瓣（B对）附着于右房室口周缘的三尖瓣环上。